各型牙内陷中最严重的是
A. 畸形根面沟
B. 畸形舌侧窝
C. 畸形舌侧尖
D. 牙中牙
E. 釉珠

正确答案：D。牙中牙

解析：本题考查牙内陷。各型牙内陷中最严重的是牙中牙（D对）。牙内陷为牙发育时期，成釉器过度卷叠或局部过度增殖，深入到牙乳头中所致。根据牙内陷的深浅程度及其形态变异，临床上可分为：畸形舌侧窝，畸形根面沟，畸形舌侧尖和牙中牙，其中畸形舌侧窝是最轻的一种（B错），牙中牙是最严重的一种（D对AC错）。釉珠是牢固附着于牙骨质表面的釉质小块，大小似粟粒，呈球形，它多位于磨牙根分叉内或其附近，或位于釉牙骨质界的根面上，不属于牙内陷（E错）。